女，28岁。在心理咨询中谈到所交的两个男朋友她都很喜欢，不知道该与哪个继续相处，难以做出抉择，希望得到帮助，而根据心理治疗的原则，心理咨询师没有替她作出决定。该咨询师遵循的原则是
A. 灵活原则
B. 综合原则
C. 中立原则
D. 耐心原则
E. 回避原则

正确答案：C。中立原则

解析：根据第6版医学心理学，心理治疗的基本原则有信赖性原则、整体性原则、发展性原则、个性化原则、中立性原则、保密性原则。治疗者有自己的人生经历和人生价值取向，如果在治疗过程中，治疗者以自己的价值取向作为考虑问题的参照点或以某种固定的价值取向作为判断是非的参照点，就容易妨碍对事件判断的客观性，把个人情绪带人治疗之中，丧失应有的中立态度。此题中，对于患者提出的问题，咨询师最应注意中立性原则（C对），才能对患者的情况客观分析并提出适宜的处理方法。灵活原则（A错）、综合原则（B错）、耐心原则（D错）、回避原则（E错）均不是心理治疗的原则。